染色体数目异常的表现不包括
A. 单倍体
B. 二倍体
C. 三倍体
D. 四倍体

正确答案：B。二倍体

解析：本题考查染色体数目异常的表现。染色体数目异常的表现包括单倍体（A对）、三倍体（C对）和四倍体（D对）等，不包括二倍体（B错，为本题正确答案）。